下列哪项不是主要病原性衣原体引起的疾病
A. 沙眼
B. 鹦鹉热
C. 回归热
D. 肺炎
E. 性病淋巴肉芽肿

正确答案：C。回归热

解析：主要病原性衣原体分为三种：①沙眼衣原体（沙眼、性病淋巴肉芽肿）；②肺炎嗜衣原体（肺炎、支气管炎）；③鹦鹉热嗜衣原体（鹦鹉热）。掌握“衣原体”知识点。